羚羊角的性状鉴别特征有
A. 呈长圆锥形，略呈弓形弯曲
B. 黄棕色或黄褐色
C. 除顶端部分外，有10～16个隆起环脊
D. 基部横截面类圆形，内有坚硬质重的角柱
E. 气无，味淡

正确答案：A、C、D。呈长圆锥形，略呈弓形弯曲；除顶端部分外，有10～16个隆起环脊；基部横截面类圆形，内有坚硬质重的角柱

解析：本题考查的是羚羊角药材的性状鉴别。羚羊角的性状鉴别特征有呈长圆锥形，略呈弓形弯曲（A对）、除顶端部分外，有10～16个隆起环脊（C对）与基部横截面类圆形，内有坚硬质重的角柱（D对）。羚羊角：【性状鉴别】药材呈长圆锥形，略呈弓形弯曲。类白色或黄白色（B错），基部稍呈青灰色。嫩枝对光透视有“血丝”或紫黑色斑纹，光润如玉，无裂纹，老枝有细纵裂纹。除顶端部分外，有10～16个隆起环脊，用手握之，四指正好嵌入凹处。角基部横截面类圆形，内有坚硬质重的角柱，习称“骨塞”。除去“骨塞”后，角的下半部呈空洞，全角呈半透明，对光透视，上半段中央有一条隐约可辨的细孔道直通角头，习称“通天眼”。质坚硬，气微，味淡（E错）。